医师在执业活动中发生医疗事故不按规定报告的，应承担的法律责任是
A. 行政罚款处罚
B. 暂停1至6个月的执业活动
C. 暂停6至12个月的执业活动
D. 注销执业证书
E. 以上都不是

正确答案：C。暂停6至12个月的执业活动